与银汞合金充填比较铸造嵌体的优点是
A. 机械性能优良
B. 固位好
C. 边缘线短
D. 牙体切割少
E. 制作方便

正确答案：A。机械性能优良

解析：本题考查嵌体的优点。与银汞充填体相比，金属合金嵌体在强度、耐久性上更优越，嵌体的机械性能优良（A对）。银汞合金充填体与牙体组织没有粘结性，是靠材料与洞壁间的摩擦力和机械扣锁固位；铸造嵌体是靠摩擦力与粘结力固位，嵌体适用于牙体缺损较小的修复治疗，因而洞型粘结面积较小，所产生的粘结力也较小，两者相比较而言，银汞充填采用的倒凹固位、鸠尾固位等固位形所产生的机械固位力要大于粘结力，因而银汞合金充填的固位要比铸造嵌体好（B错）。与充填体相比，嵌体的边缘线长（C错），发生龋坏的几率更大。嵌体是间接修复体，需要一定的扩展预备才能顺利戴入，因此嵌体牙体预备时需要去除倒凹，当缺损范围相同时，需要比充填洞型牙体切割多（D错）。银汞合金可以直接充填，铸造嵌体要牙体制备、印模制取，还要制作嵌体，最后才能粘固，相较于银汞充填而言，嵌体制作不方便（E错）。